利培酮的半衰期大约为3小时，但用法为一日2次，其原因被认为利培酮代谢产物也具有相同的生物活性，利培酮的活性代谢产物是
A. 齐拉西酮
B. 洛沙平
C. 阿莫沙平
D. 帕利哌酮
E. 帕罗西汀

正确答案：D。帕利哌酮

解析：本题考查利培酮的活性代谢产物。帕利哌酮（D对）是利培酮的活性代谢产物。利培酮是运用骈合原理设计的非经典抗精神病药物，口服吸收完全，在肝脏受CYP2D6酶催化，生成帕利哌酮和N-去烃基衍生物，均具有抗精神病活性。利培酮原药的半衰期只有3小时，但主要活性代谢物帕利哌酮的半衰期长达24小时。骈合原理是指将两种具有生物活性的化合物通过共价键连接起来，在体内分解成两个有效成分，以减小两种药物的毒副作用。齐拉西酮（A错）也是根据骈合原理而设计的非经典抗精神病药，是非利培酮的活性代谢产物。阿莫沙平（C错）是洛沙平（B错）的脱甲基代谢物，通过抑制脑内突触前膜对去甲肾上腺素的再摄取产生较强的抗抑郁作用。帕罗西汀（E错）主要经肝脏代谢降解，代谢产物无药理活性，不是利培酮的活性代谢产物。